评价学校口腔健康教育后学生对早晚刷牙等口腔保健所持的观点、态度转变时可使用的健康信念指标是
A. 形成率
B. 检出率
C. 知晓率
D. 正确应答率
E. 因病缺课率

正确答案：D。正确应答率